我国不允许使用的食品防腐剂有
A. 山梨酸
B. 对羟基苯甲酸甲酯
C. 对羟基苯甲酸乙酯
D. 丙酸
E. 脱氢醋酸

正确答案：B。对羟基苯甲酸甲酯